两样本率比较可用u检验的条件是
A. 两个样本率的差别大
B. 两个样本率的差别小
C. 两个样本率均较大
D. 两个样本率均较小
E. 两个样本含量均较大，且两个样本率均不接近0也不接近1

正确答案：E。两个样本含量均较大，且两个样本率均不接近0也不接近1